甲类传染病是指
A. 鼠疫、狂犬病
B. 黑热病、炭疽
C. 鼠疫、炭疽
D. 鼠疫、霍乱
E. 炭疽、霍乱

正确答案：D。鼠疫、霍乱

解析：鼠疫、霍乱属于甲类传染病（D对）；狂犬病、炭疽属于乙类传染病；黑热病属于丙类传染病（B错）。